下列不属于巨幼细胞性贫血实验室检查结果的是
A. 外周血中性粒细胞呈多分叶
B. 骨髓可见巨中、晚幼粒细胞
C. 外周血红细胞MCV増大
D. 骨髓巨核细胞胞体増大，分叶过多
E. 骨髓有核红细胞呈“幼浆老核”现象

正确答案：E。骨髓有核红细胞呈“幼浆老核”现象

解析：骨髓有核红细胞呈“核老浆幼”现象（E错，为本题正确案）现象为缺铁性贫血骨髓象。巨幼细胞性贫血实验室检查可见外周血MCV（C对）、MCH均增高，MCHC正常。中性粒细胞呈多分叶（A对）（5叶核占5%以上或出现6叶以上核），亦可见巨型杆状核粒细胞。骨髓像可见巨中、晚幼粒细胞（B对），巨杆状核粒细胞，成熟粒细胞分叶过多；巨核细胞体积增大，分叶过多（D对）